六淫邪气中，易伤肺的是
A. 风邪
B. 燥邪
C. 湿邪
D. 寒邪
E. 火邪

正确答案：B。燥邪

解析：本题考查的是燥邪的性质。六淫邪气中，易伤肺的是燥邪（B对）。燥邪的性质：（1）燥性干涩，易伤津液。（2）燥易伤肺。风邪（A错）的性质：（1）风为阳邪，其性开泄，易袭阳位。（2）风邪善行而数变。（3）风为百病之长。湿邪（C错）的性质：（1）湿为阴邪，易阻遏气机，损伤阳气。（2）湿性重浊。（3）湿性黏滞。（4）湿性趋下，易伤阴位。寒邪（D错）的性质：（1）寒为阴邪，易伤阳气。（2）寒性凝滞，主痛。（3）寒性收引。火热之邪（E错）的性质：（1）火热为阳邪，其性炎上。（2）火易伤津耗气。（3）火热易生风动血。（4）火热易发肿疡。